可待因是
A. 第一类精神药品
B. 第二类精神药品
C. 麻醉药品
D. 毒性药品
E. 放射性药品

正确答案：C。麻醉药品

解析：本题考查麻醉药品。可待因是麻醉药品（C对）。麻醉药品是指连续使用后易产生身体依赖性、能成瘾癖的药品。《麻醉药品品种目录（2013版）》共121个品种，其中我国生产及使用的品种及包括的制剂、提取物、提取物粉共有27个品种，具体有以下品种。1.可卡因；2.罂粟浓缩物（包括罂粟果提取物、罂粟果提取物粉）；3.二氢埃托啡；4.地芬诺酯；5.芬太尼；6.氢可酮；7.氢吗啡酮；8.美沙酮；9.吗啡（包括吗啡阿托品注射液）；10.阿片（包括复方樟脑酊、阿桔片）；11.羟考酮；12.哌替啶；13.瑞芬太尼；14.舒芬太尼；15.蒂巴因；16.可待因；17.右丙氧芬；18.双氢可待因；19.乙基吗啡；20.福尔可定；21.布桂嗪；22.罂粟壳。目前，目录确定的我国生产及使用的第一类精神药品（A错）有7个品种，具体有以下品种。1.哌醋甲酯；2.司可巴比妥；3.丁丙诺啡；4.γ-羟丁酸；5.氯胺酮；6.马吲哚；7.三唑仑。目前，目录确定的我国生产及使用的第二类精神药品（B错）有29个品种，具体有以下品种。1.异戊巴比妥；2.格鲁米特；3.喷他佐辛；4.戊巴比妥；5.阿普唑仑；6.巴比妥；；7.氯硝西泮；9.地西洋；9.艾司唑仑；10.氟西泮；11.劳拉西泮；12.甲丙氨酯；13.咪达唑仑；14.硝西泮；15.奥沙西泮；16.匹莫林；17.苯巴比妥；18.唑吡坦；19.丁丙诺啡透皮贴剂；20.布托啡诺及其注射剂；21.咖啡因；22.安钠咖；23.地佐辛及其注射剂；24.麦角胺咖啡因片；25.氨酚氢可酮片；26.曲马多；27.扎来普隆；28.佐匹克隆。医疗用毒性药品（简称毒性药品）（D错）是指毒性剧烈，治疗剂量与中毒剂量相近，使用不当会致人中毒或死亡的药品。毒性药品中药品种共27种：砒石（红砒、白砒）、砒霜、水银、生马钱子、生川乌、生草乌、生白附子、生附子、生半夏、生南星、生巴豆、斑蝥、青娘虫、红娘子、生甘遂、生狼毒、生藤黄、生千金子、生天仙子、闹羊花、雪上一枝蒿、白降丹、蟾酥、洋金花、红粉、轻粉、雄黄。放射性药品（E错）是指用于临床诊断或者治疗的放射性核素制剂或者其标记化合物。